为保障公民临床急救用血的需要，国家提倡并指导择期手术的患者
A. 率先献血
B. 互助献血
C. 自愿献血
D. 自身储血
E. 同型输血

正确答案：D。自身储血

解析：《献血法》规定，为保障公民临床急救用血的需要，国家提倡并指导择期手术的患者自身储血（D对），动员家庭、亲友、所在单位以及社会互助献血。